不属于自我控制菌斑的方法有
A. 刷牙
B. 漱口
C. 牙线的使用
D. 洁治
E. 牙签的使用

正确答案：D。洁治

解析：本题考查自我控制菌斑的方法。洁治（D错，为本题的正确答案）术是医生用洁治器去除龈上牙石、菌斑和色素，如手用器械洁治、超声波洁牙机洁治术、刮治术，帮助患者控制菌斑。自我控制菌斑是指患者自觉地采取一定的口腔清洁措施以控制菌斑，菌斑控制的方法很多，有机械法如刷牙（A对），牙线的使用（C对）、牙签的使用（E对）和化学性方法如用漱口液漱口（B对）。